年轻恒牙由于深龋露髓，穿髓孔周围为较硬的牙本质时，穿髓孔的大小与牙髓感染范围的关系
A. 正比
B. 反比
C. 等比
D. 无关系
E. 需要依据其情况而定

正确答案：A。正比

解析：年轻恒牙龋源性露髓在穿髓孔周围是较硬的牙本质时，穿髓孔的大小与牙髓感染的范围呈正比关系。掌握“年轻恒牙牙髓病及根尖周病诊断及治疗”知识点。